某地居民因食用被HAV污染的毛蚶而发生甲型肝炎暴发流行，此毛蚶称为
A. 传染源
B. 储存宿主
C. 传播因素
D. 流行环节
E. 病原携带者

正确答案：B。储存宿主

解析：本题考查储存宿主。储存宿主一般指人以外的终末宿主，可通过动物与动物之间传播，也可通过动物污染食物或水源，再传染给另一只动物。某地居民因食用被HAV污染的毛蚶而发生甲型肝炎暴发流行，此毛蚶称为储存宿主（B对ACDE错）。